硫基与糖端基羟基脱水形成的苷是
A. 氧苷
B. 硫苷
C. 氮苷
D. 三糖苷
E. 二糖苷

正确答案：B。硫苷

解析：本题考查的是苷的分类。硫基与糖端基羟基脱水形成的苷是硫苷（B对）。硫苷：糖端基羟基与苷元上巯基缩合而成的苷称为硫苷。如萝卜苷、芥子苷。醇苷（A错）：是通过醇羟基与糖端基羟基脱水而成的苷，如红景天苷、毛茛苷、獐牙菜苷。氮苷（C错）：通过氮原子与糖的端基碳相连的苷称为N-苷。如巴豆苷。二糖苷（E错）、三糖苷（D错）属于根据连接单糖基的个数而进行的分类。根据连接单糖基的个数分为单糖苷、二糖苷等。